患者，女，28岁，已婚。月经50天一行，量少、色淡、质稀，小腹隐痛，喜热喜按，腰酸无力，大便溏薄，小便清长，舌淡苔白，脉沉细而迟。治疗应首选
A. 温经汤《金匮要略》
B. 艾附暖宫丸
C. 温胞饮
D. 大补元煎
E. 人参养荣汤

正确答案：A。温经汤《金匮要略》

解析：正常月经周期为28-30天，月经50天一行属月经推迟，阳气不足，阴寒内盛，不能温养脏腑，气血生化不足，气虚血少，冲任不充，血海满溢延迟故月经推迟而至，量少。阳虚血失温煦故色淡红，质稀，阳虚不能温养子宫，故出现小腹隐痛，喜暖喜按；阳虚肾气不足，腰为肾之府，故出现腰酸无力，大便溏薄，小便清长，舌淡苔白，脉沉细而迟均为阳虚失煦，不能生血行血，血脉不充之象，属月经后期血寒证之虚寒证，宜扶阳祛寒调经，温经汤的功效为温经散寒，养血祛瘀，为月经后期血寒证之虚寒证之首选（A对）。艾附暖宫丸的功效为理气补血，暖宫调经，治疗虚寒所致的痛经（B错）。温胞饮的功效为温肾助阳暖宫，填精助孕，用于治疗肾阳虚之不孕症（C错）。大补元煎的功效为大补元气，益精填血，用于治疗血虚证（D错）。人参养荣汤的功效为益气补血，养心安神，用于治疗心脾气血两虚证（E错）。